不宜制成硬胶囊的药物
A. 具有不良嗅味的药物
B. 吸湿性强的药物
C. 易溶性的刺激性药物
D. 药物水溶液或乙醇溶液
E. 难溶性药物

正确答案：B、C、D。吸湿性强的药物；易溶性的刺激性药物；药物水溶液或乙醇溶液

解析：本题考查胶囊剂。吸湿性强的药物（B对）、易溶性的刺激性药物（C对）、药物水溶液或乙醇溶液（D对）不宜制成硬胶囊。吸湿性强的药物会导致囊壁脆裂；胶囊壳在体内溶化后，局部药量很大，易溶性的刺激性药物不宜制成胶囊剂；药物水溶液或乙醇溶液会导致囊壁溶化。具有不良气味的药物（A错）、难溶性药物（E错）都可以制成胶囊剂。